以下属于口腔颌面部潴留性囊肿的是
A. 皮样囊肿
B. 甲状舌管囊肿
C. 皮脂腺囊肿
D. 鳃裂囊肿
E. 外渗性囊肿

正确答案：C。皮脂腺囊肿

解析：皮脂腺囊肿中医称“粉瘤”。主要为由皮脂腺排泄管阻塞，皮脂腺囊状上皮被逐渐增多的内容物膨胀而形成的潴留性囊肿。掌握“皮脂腺、皮样或表皮样囊肿”知识点。